入院时患者已处于某种传染病的潜伏期，住院后发病，并引起其他易感者患该种传染病，称为
A. 外源性感染
B. 交叉感染
C. 医源性感染
D. 自身感染
E. 带入感染

正确答案：E。带入感染